男，50岁。行胃癌根治术后2小时腹腔引流出不凝血800ml。BP86/60mmHg，CVP由8cmH₂O降至4cmH₂O。此时应采取的最恰当的措施是
A. 给予血管收缩药
B. 补液观察
C. 再次手术止血
D. 内镜电凝血
E. 输血观察

正确答案：B。补液观察

解析：患者50岁，男性。行胃癌根治术后2小时腹腔引流出不凝血800ml（腹腔内引流出较多新鲜血可确诊腹腔内出血）。BP86/60mmHg（血压及脉压降低，提示存在休克），CVP由8cmH₂O降至4cmH₂O（正常值5～10cmH₂O，提示血容量不足）。根据该患者的临床表现、体征及实验室检查可确诊为术后腹腔内出血伴休克。在足量补液和输血后，若休克仍无好转，应再次手术止血。题干要求回答的是“此时应采取的措施“，故我们选择补液观察（B对C错） 。抢救休克时，应先补液再输血（E错）。给予血管收缩药（A错）和内镜电凝血（D错）均不是休克的关键治疗措施。